引发气瘿的主要因素是
A. 情志内伤
B. 肝肾不足
C. 脾胃不和
D. 气郁痰凝
E. 心脾两虚

正确答案：A。情志内伤

解析：气瘿，随喜怒消长，女性发病率较男性略高，一般多发生在青春期，情志不畅，忧怒无节，导致气化失调，升降障碍，营运阻塞。（A对）。肝肾不足、脾胃不和、气郁痰凝和心脾两虚不是引发气瘿的发病因素（BCDE错）。